某人常食用方便面类食品，近日出现牙龈肿痛出血，皮肤瘀点或瘀斑，乏力，失眠，腹泻，他最有可能患的营养素缺乏病是
A. 维生素A缺乏病
B. 烟酸缺乏病（癞皮病）
C. 维生素B₁缺乏病（脚气病）
D. 维生素B₂缺乏病（核黄素缺乏病）
E. 维生素C缺乏病（坏血病）

正确答案：E。维生素C缺乏病（坏血病）